宜用醋灸法炮制的中药有
A. 甘遂
B. 乳香
C. 柴胡
D. 五灵脂
E. 白术

正确答案：A、B、C、D。甘遂；乳香；柴胡；五灵脂

解析：本题考查的是适用于醋灸法炮制的中药。宜用醋灸法炮制的中药有甘遂（A对）、乳香（B对）、柴胡（C对）与五灵脂（D对）。醋炙法：将净选或切制后的药物，加入定量米醋拌炒至规定程度的方法。醋炙的主要目的：①降低毒性，缓和药性。如甘遂、京大戟、芫花、商陆等。②引药入肝，增强活血止痛作用。如乳香、没药、三棱、莪术等。③矫臭矫味。如乳香、没药、五灵脂等。醋甘遂毒性减低，峻泻作用缓和。醋乳香刺激性缓和，利于服用，便于粉碎。醋炙乳香还能增强活血止痛、收敛生肌的功效，并可矫臭矫味。醋柴胡升散之性缓和，疏肝止痛的作用增强。醋五灵脂增强散瘀止痛作用，并可矫臭矫味。白术（E错）采用土炒法、麸炒法炮制。